成人末梢血白细胞计数正常参考值
A. （4.0～10.0）×10⁹
B. （5.0～11.0）×10⁹
C. （6.0～12.0）×10⁹
D. （7.0～13.0）×10⁹
E. （8.0～14.0）×10⁹

正确答案：A。（4.0～10.0）×10⁹

解析：本题考查白细胞计数。白细胞计数正常参考范围：成人：（4.0～10.0）×10⁹/L（A对）；新生儿：（15.0～20.0）×10⁹/L（B错）；6个月至2岁婴幼儿：（11.0～12.0）×10⁹/L。